产褥病率的定义是
A. 指分娩24小时内每小时测体温，测量4次，体温有2次达到或超过38℃
B. 产褥期内有两次体温达到或超过38℃
C. 产后24小时以后的10日内用口表每日测量4次，体温有2次达到或超过38℃
D. 产后24小时以后1周内用口表每日测量4次体温，有2次达到或超过38℃
E. 产后24小时以后的1个月内用口表每日测量4次，体温有2次达到或超过38℃

正确答案：C。产后24小时以后的10日内用口表每日测量4次，体温有2次达到或超过38℃